患者，女，18岁。2周前患扁桃体炎，近日心悸，气短，发热，出汗，踝、膝关节游走性疼痛。查体：心率110次/分，第一心音减弱，上肢内侧皮肤有环形红斑。应首先考虑的是
A. 病毒性心肌炎
B. 类风湿关节炎
C. 风湿热
D. 亚急性感染性心内膜炎
E. 系统性红斑狼疮

正确答案：C。风湿热

解析：患者青少年女性，2周前患扁桃体炎，近日心悸，气短，发热，出汗，踝、膝关节游走性疼痛，且心率增快，第一心音减弱，上肢内侧皮肤有环形红斑，患者临床表现与风湿热相符，故患者最可能的诊断是风湿热（C对）。病毒性心肌炎轻者可完全没有症状，重者甚至可出现心源性休克，多数患者有病毒感染前驱症状，如发热、全身倦怠感等，随后出现心悸、胸痛、呼吸困难、水肿等症状（A错）。类风湿关节炎主要表现为晨僵、关节痛与压痛、关节肿及关节畸形（B错）。亚急性感染性心内膜炎主要表现为发热、心脏杂音、皮肤瘀点、Roth斑、Janeway损害等（D错）。系统性红斑狼疮主要表现为发热、面颊部蝶形红斑及肾脏受累等（E错）。